由载体介导的易化扩散发生饱和现象的机制是
A. 跨膜浓度梯度降低
B. 载体特异性较差
C. 跨膜电位梯度降低
D. 物质转运能量不足
E. 载体转运达极限

正确答案：E。载体转运达极限

解析：由载体介导的易化扩散称为经载体易化扩散，其载体为一类贯穿脂质双分子层的膜整合蛋白。经载体易化扩散有以下特点：①选择性：载体与转运物质的结合具有化学结构特异性，只有能被载体识别的物质才能被该载体转运。当载体对一种被转运物质特异性较差，载体会优先转运另一种特异性好的物质，所以载体的特异性较强（B错）；②饱和性：由于膜上载体和载体结合位点的数目均有限，因此，当被转运物质浓度达到一定水平时，该物质转运速率不会随被转运物质的浓度升高而升高，载体转运达极限。当被转运的底物浓度增加到一定程度时，底物的扩散速度便达到最大值，不再随底物浓度的增加而增大，这种现象称为载体转运的饱和现象。载体转运的饱和现象的原因是由于细胞膜中载体的数量和转运速率有限，因此当被转运的底物浓度增加到一定程度时，底物的扩散速度就不再随底物浓度的增加而增大。（E对），即出现所谓饱和现象；③竞争抑制性：分子结构相似的不同物质经同一载体转运时，A物质转运增加会造成B物质转运减少，反之亦然，造成彼此之间的竞争性抑制。跨膜浓度梯度降低（A错）、跨膜电位梯度降低（C错）会降低转运速率，跟饱和现象无关。易化扩散是被动转运，物质转运的动力来自该物质的浓度差，此过程不消耗能量，故物质转运能量不足（D错）和易化扩散无关。